抗休克治疗时，指标情况改善与尿量增加直接相关的是
A. 微循环灌注
B. 心排血量
C. 动脉舒张压
D. 肺毛细血管楔压
E. 中心静脉压

正确答案：A。微循环灌注

解析：抗休克治疗时，微循环灌注是与尿量增加直接相关的指标（A对），尿量<25ml/h、比重增加者提示血管收缩和供血量不足，血压正常但尿量仍少且比重偏低者提示有急性肾衰竭可能，当尿量维持在30ml/h以上时说明休克已好转；动脉舒张压的高低主要反映右心室功能和血管舒张功能（C错）；心排血量（B错）和肺毛细血管楔压（D错）可通过Swan-Ganz漂浮导管测得，均可反映肺静脉、左心房和左心室的功能状态；中心静脉压（E错）可反映全身血容量与右心功能之间的关系。